关于色甘酸钠的叙述，错误的是
A. 适用于孕妇及哺乳期妇女的哮喘发作
B. 将其制成气雾剂可以避免首过效应
C. 其粉雾剂易潮解，应置于干燥处保存
D. 适用于预防过敏性支气管哮喘
E. 口服有时可引起恶心或食欲不振

正确答案：A。适用于孕妇及哺乳期妇女的哮喘发作